口服给药后，血药浓度的药时曲线具有典型肝肠循环药代动力学特征的化合物是
A. 麦芽糖
B. 黄芩苷
C. 马兜铃酸B
D. 苦参碱
E. 麝香酮

正确答案：B。黄芩苷

解析：本题考查的是黄芩苷的代谢动力学。口服给药后，血药浓度的药时曲线具有典型肝肠循环药代动力学特征的化合物是黄芩苷（B对）。黄芩苷的代谢动力学：黄芩苷的结构有两个特点，一是黄芩苷是苷元与葡萄糖醛酸形成的苷，这与其他葡萄糖苷等苷类化合物不同，该化合物具有弱酸性，酸性条件下稳定；二是黄芩苷水解后的产物黄芩素A环上有三个相邻的羟基，该化合物在肝脏代谢酶的作用下，三个羟基可以发生葡萄糖醛酸化、硫酸化或甲基化的Ⅱ相代谢途径。黄芩素在小肠上皮细胞受到葡萄糖醛酸转移酶催化，可重新转化为葡萄糖醛酸的苷形式，既又可重新生成黄芩苷，这是黄芩苷肝肠循环的主要原因。